性激素疗法的使用原则不包括
A. 足量、全程
B. 严格掌握性激素疗法的适应证，避免滥用
C. 低剂量
D. 个体化
E. 掌握应用性激素的时机

正确答案：A。足量、全程

解析：本题考查性激素疗法的使用原则。性激素治疗在使用时需要严格掌握性激素疗法的适应证，避免滥用（B对），低剂量（C对）、个体化（D对），掌握应用性激素疗法的时机（E对）而不是足量全程（A错，为本题正确答案）。性激素治疗只是更年期妇女综合保健的一种医疗措施，代替不了更年期妇女的整体保健。应该对绝经前妇女提供激素替代疗法益处和风险的咨询。